牙周附着丧失是指
A. 龈缘至膜龈联合的距离
B. 牙周袋底至牙槽骨嵴顶的距离
C. 牙周袋底至釉牙骨质界的距离
D. 游离龈沟底至膜龈联合的角化牙龈的距离
E. 龈缘至牙周袋底的距离

正确答案：C。牙周袋底至釉牙骨质界的距离

解析：本题考查牙周附着丧失。牙周附着丧失是指牙周袋底至釉牙骨质界的距离（C对）。附着丧失是牙周支持组织破坏的结果，是区别牙龈炎和牙周炎的一个重要标志。附着丧失是指牙周袋底至釉牙骨质界的距离。